鼻部手术后，最常使用的绷带包扎方法是
A. 卷带
B. 三角巾
C. 四头带
D. 石膏绷带
E. 单眼交叉绷带

正确答案：C。四头带

解析：本题考查绷带的选择。鼻部手术后，最常使用的绷带包扎方法是四头带（C对）。某些颌骨中小型手术后，为止血和减轻水肿，常用四头带包扎或加压。四头带也用于颏部创口的包扎固定。绷带的种类较多，常用的有卷带、四头带和三角巾，此外，还有弹性绷带和石膏绷带。绷带的包扎方法有多种，可根据创口的部位、特点等选择适宜的绷带和包扎方法。卷带（A错）是颌面部绷带最常使用的绷带卷带，有时也可用三角巾或毛巾等代替。三角巾（B错）可对全身各部位进行止血和包扎，尤其是对肩部、胸部、腹股沟部和臀部等不易包扎的部位使之变得简单易行，在口腔颌面外科全麻手术中也可作为包头巾使用。四头带常用于包扎鼻部、下颌、颏部创口，也用于压迫术后创口。石膏绷带（D错）用途很广，在颌面部常用于制作石膏帽，以利颌骨骨折的牵引复位、固定。单眼交叉绷带（E错）常用于上颌骨、面、颊部手术后的创口包扎。